突发公共卫生事件是指
A. 突然发生的严重影响公共健康的事件
B. 突然发生，造成社会公众健康严重损害的重大传染病疫情
C. 突然发生，造成社会公众健康严重损害的群体性不明原因疾病
D. 突然发生，造成社会公众健康严重损害的重大食物和职业中毒事件
E. 突然发生，造成或者可能造成社会公众健康严重损害的重大传染病疫情、群体性不明原因疾病、重大食物中毒和职业中毒以及其他严重影响公众健康的事件

正确答案：E。突然发生，造成或者可能造成社会公众健康严重损害的重大传染病疫情、群体性不明原因疾病、重大食物中毒和职业中毒以及其他严重影响公众健康的事件

解析：突发公共卫生事件，是指突然发生，造成或者可能造成社会公众健康严重损害的重大传染病疫情、群体性不明原因疾病、重大食物和职业中毒以及其他严重影响公众健康的事件。掌握“突发公共卫生事件报告与法律责任”知识点。